牙拔除术时，患有何种疾病时，术前后应采取抗感染措施，局麻药中不应加入肾上腺素
A. 贫血
B. 血友病
C. 恶性肿瘤
D. 肿瘤患者
E. 甲状腺功能亢进

正确答案：E。甲状腺功能亢进

解析：甲状腺功能亢进：拔牙可导致甲状腺危象的发生。必须拔牙时，应在治疗后，基础代谢率控制在+20以下，脉搏不超过100次/分时进行。手术前后应采取抗感染措施，局麻药中不应加入肾上腺素。掌握“牙拔除的适应证与禁忌证”知识点。